在正常X线根尖片中包绕牙根的一条白色阻射线属于牙周组织中的
A. 牙周膜
B. 牙骨质
C. 筛状板
D. 牙本质
E. 牙釉质

正确答案：C。筛状板

解析：本题考查牙周组织的组织结构。在正常X线根尖片中包绕牙根的一条白色阻射线属于牙周组织中的筛状板（C对）。筛状板是检查牙周组织的重要标志。牙周膜发生炎症和外伤性变化时，硬骨板首先消失。牙周组织包括牙周膜、牙槽骨、牙骨质和牙龈。牙周膜（A错）又称牙周韧带，是连接牙骨质与牙槽骨之间的致密结缔组织，主要功能是抵抗和调节咀嚼过程中牙承受的压力。牙骨质（B错）是覆盖于牙根表面的一层硬结缔组织，色淡黄，是维系牙和牙周组织联系的重要结构。牙本质（D错）是构成牙主体的硬组织，由成牙本质细胞分泌，主要功能是保护其内部的牙髓和支持牙釉质。牙釉质（E错）是覆盖于牙冠的高度硬化组织，是全身唯一由上皮细胞分泌继而矿化的组织。